以下叙述中，不恰当的是
A. 洞深接近牙髓，需做双层垫底
B. 氧化锌丁香油粘固粉是理想的第一层垫底材料
C. 氧化锌丁香油粘固粉用作暂封时，宜较稀以延长固化时间
D. 氧化锌丁香油粘固粉抗压强度强，能承受一定的咀嚼压力
E. 磷酸锌粘固粉可用作第二层垫底材料

正确答案：D。氧化锌丁香油粘固粉抗压强度强，能承受一定的咀嚼压力

解析：本题考查垫底相关知识。氧化锌丁香油粘固粉抗压强度强，能承受一定的咀嚼压力（D错，为本题正确答案）这个说法是不正确的。垫底（basing）是在洞底垫一层足够厚度的材料，隔绝外界刺激，同时垫平洞底，形成窝洞，承受充填压力和咀嚼力的作用。氧化锌丁香油水门汀是理想的第一层垫底材料（B对）。因其抗压程度低，不能承受咀嚼压力，须在其上用磷酸锌水门汀做第二层垫底（E对）。洞底离髓腔很近时，为了保护牙髓需要做双层垫底处理（A对）。氧化锌丁香油粘固粉用作暂封时，宜较稀以延长固化时间（C对），而垫底时应该稍稠厚一些。